关于真核生物mRNA结构的描述，错误的是
A. 最终出现于mRNA中的序列为内含子
B. 3'端有特殊的“尾”结构
C. 3'端存在非翻译序列
D. 5'端有特殊“帽子”结构
E. 含有开放阅读框架区

正确答案：A。最终出现于mRNA中的序列为内含子